糖皮质激素抗炎作用的机制包括
A. 抗菌
B. 抗病毒
C. 稳定肥大细胞膜
D. 稳定溶酶体膜
E. 抑制白烯合成

正确答案：C、D、E。稳定肥大细胞膜；稳定溶酶体膜；抑制白烯合成